石决明的原动物属于
A. 螳螂科
B. 鲍科
C. 乌贼科
D. 雉科
E. 芫青科

正确答案：B。鲍科

解析：本题考查的是石决明的来源。石决明的原动物属于鲍科（B对）。石决明：【来源】为软体动物门鲍科动物杂色鲍（九孔鲍）、皱纹盘鲍、羊鲍、澳洲鲍、耳鲍或白鲍的贝壳。来源于螳螂科（A错）的中药有桑螵蛸。桑螵蛸：【来源】为节肢动物门昆虫纲螳螂科昆虫大刀螂、小刀螂或巨斧螳螂的干燥卵鞘。来源于乌贼科（C错）的中药有海螵蛸。海螵蛸：【来源】为软体动物门乌贼科动物无针乌贼或金乌贼的干燥内壳。来源于雉科（D错）的中药有鸡内金。鸡内金：【来源】为脊索动物门鸟纲雉科动物家鸡的干燥沙囊内壁。来源于芫青科（E错）的中药有斑蝥。斑蝥：【来源】为节肢动物门昆虫纲芫青科昆虫南方大斑蝥或黄黑小斑蝥的干燥体。